治疗急性牙周脓肿，最不需要做
A. 脓肿切开引流术
B. 调磨早接触点
C. 全身给以抗生素或支持疗法
D. 牙龈翻瓣手术
E. 含漱剂含漱以改善局部环境

正确答案：D。牙龈翻瓣手术

解析：炎症的急性期不宜手术。掌握“慢性牙周炎的治疗原则、程序及方法”知识点。